女，1岁。体重9Kg。因发热、腹泻2天入院。精神萎靡，皮肤弹性差，眼窝明显凹陷，四肢冰凉，尿极少。扩容后补充累积损失量的输液速度，一般为每小时每公斤体重
A. 5～7ml
B. 8～10ml
C. 11～13ml
D. 14～16ml
E. 17～19ml

正确答案：B。8～10ml

解析：患儿有精神萎靡、皮肤弹性差、眼窝明显凹陷、四肢冰凉、尿极少的临床表现，应诊断为重度脱水，重度脱水扩容后补充累积损失量的输液速度，一般为每小时每公斤体重 8-10ml（B对）。